隔离的种类不包括
A. 严密隔离
B. 呼吸道隔离
C. 消化道隔离
D. 接触隔离
E. 生殖隔离

正确答案：E。生殖隔离

解析：隔离的种类包括严密隔离、呼吸道隔离、消化道隔离、接触隔离、血液-体液隔离、虫媒隔离和保护性隔离（E错，为本题正确答案）。